用来检查早接触点的方法不包括
A. 视诊
B. 扪诊
C. 咬合纸法
D. 咬蜡片法
E. 牙线法

正确答案：E。牙线法

解析：本题考查检查早接触点的方法。牙线法（E错，为本题的正确答案）主要用于检查有无（牙合）干扰存在。当下颌从休息位置慢慢向上移位到上下牙发生接触时，如果只有个别牙接触，而不是广泛的密切接触，这种个别牙的接触称为早接触。视诊（A对）可以初步确定早接触点，早接触的牙齿明显有咬合高点，再用其他方法进一步确定准确位置。扪诊（B对）指用示指的指腹轻按于上颌牙的唇（颊）面近颈部，让患者作咬合动作，手指感到较大的震动或动度的牙，可能有早接触的存在。咬合纸法（C对）指擦干牙的（牙合）面，将薄型的咬合纸放于下（牙合）面上，令患者作正中咬合，然后取出咬合纸检查，一般在牙合面的蓝色印迹比较均匀，若有浓密蓝点且范围较大，甚至将纸咬穿，该处牙面可呈中心白点而周围蓝色，即为早接触点。咬蜡片法（D对）指用厚度均匀的薄型蜡片，烤软后放在被检查牙的（牙合）面，令患者作正中咬合，待蜡片冷却后取出，然后对光透照检查蜡片上的咬合印迹。若有菲薄透亮甚至穿孔区，即为早接触点。